痛风急性发作期应禁用的药物
A. 碳酸氢钠
B. 别嘌醇
C. 秋水仙碱
D. 布洛芬
E. 吲哚美辛

正确答案：B。别嘌醇

解析：本题考查痛风治疗药。痛风急性发作期应禁用的药物别嘌醇（B错，为本题正确答案）。痛风可服用碳酸氢钠（A对）适当碱化尿液。秋水仙碱（C对）是治疗急性痛风的首选药物。布洛芬（D对）、吲哚美辛（E对）可抗炎、缓解痛风剧痛。